患者女，51岁，身高155cm，体重69kg，因外阴部瘙痒就诊。实验室检查空腹血糖7.2mmol/L，餐后2小时血糖12.0mmol/L，糖化血红蛋白7.2%，三酰甘油酯1.72mmol/L，胆固醇6.4mmol/L，血肌酐70gmol/L，尿常规正常。该患者确诊为2型糖尿病，应首选的降糖药是
A. 阿卡波糖
B. 格列本脲
C. 二甲双胍
D. 罗格列酮
E. 那格列奈

正确答案：C。二甲双胍